药物与作用靶标之间的一种不可逆的结合形式，作用强而持久，很难断裂，这种键合类型是
A. 共价键键合
B. 范德华力键合
C. 偶极-偶极相互作用键合
D. 疏水性相互作用键合
E. 氢键键合

正确答案：A。共价键键合

解析：本题考查共价键键合。药物与作用靶标之间的一种不可逆的结合形式，作用强而持久，很难断裂，这种键合类型是共价键键合（A对）。共价键键合：键能较大（键能150～1100kJ/mol），作用强而持久，除非被体内特异的酶解断裂外，很难断裂。因此，以共价键结合的药物，是一种不可逆的结合形式。范德华引力（B错）来自于分子间暂时偶极产生的相互吸引。偶极-偶极相互作用键合（C错）是由于羰基的氧原子和碳原子之间因电负性差异，导致电子在氧和碳原子之间的不对称分布，在与另一个极性羰基之间产生静电相互作用。疏水性相互作用（D错）是非极性分子之间的一种弱的、非共价的相互作用。氢键（E错）的生成是由于药物分子中含有孤对电子的O，N，S等原子和与非碳的杂原子以共价键相连的氢原子之间形成的弱化学键。